患者，男，7岁。暑期外出旅游，回家当晚高热，头痛，呕吐。可能感染的疾病是
A. 流行性脑炎
B. 麻疹
C. 艾滋病
D. 水痘
E. 结核

正确答案：A。流行性脑炎

解析：7岁男性患儿（流行性脑炎的好发人群），暑期（流行性脑炎的流行季节）外出旅游（提示可能去过流行性脑炎的疫区），回家当晚高热，头痛，呕吐（提示可能存在颅内感染及颅内高压可能）。综合该患者的年龄、病史及临床表现，可能感染的疾病是流行性脑炎（A对）。麻疹（P65）（B错）常冬春季发病，但全年均可发生，主要临床表现有发热、咳嗽、流涕等卡他症状及眼结合膜炎，特征性表现为口腔麻疹黏膜斑（Koplic spot）及皮肤斑丘疹。艾滋病（P112）（C错）传染途径包括性接触传播、血液接触传播及母婴传播，该患儿无艾滋病的暴露史，暂不考虑艾滋病可能，且艾滋病急性期常有肌痛、淋巴结肿大及神经系统症状等。水痘（P69）（D错）多有14～16天的潜伏期，且多为低热，儿童常同时有皮疹出现。结核（P215）（E错）常起病缓慢，且有长期午后低热，可有倦怠、盗汗、食欲下降、体重减轻等全身症状。